糖尿病合并妊娠、糖尿病合并酮症酸中毒患者选用
A. 双胍类
B. α-葡萄糖苷酶抑制剂
C. 磺酰脲类
D. 胰岛素与胰岛素类似物
E. 血管紧张素转换酶抑制剂

正确答案：D。胰岛素与胰岛素类似物

解析：本题考查糖尿病的治疗。糖尿病合并妊娠及妊娠期糖尿病、糖尿病合并酮酸中毒者、高渗性昏迷、乳酸性酸中毒、各种应激情况应选用胰岛素（D对）注射。